在治疗剂量下，下列哪些药物静脉注射能引起严重的低血压
A. 利多卡因
B. 普鲁卡因胺
C. 普萘洛尔
D. 奎尼丁
E. 苯巴比妥钠

正确答案：B、D。普鲁卡因胺；奎尼丁

解析：本题考查药物的不良反应。在治疗剂量下，普鲁卡因胺（B对）和奎尼丁（D对）静脉注射能引起严重的低血压。奎尼丁阻断α受体，能使血管扩张，减弱心肌收缩力，可引起低血压。普鲁卡因胺口服可有胃肠道反应，静脉给药可引起低血压。利多卡因（A错）不良反应主要表现为中枢神经系统症状，肝功能不良患者静脉注射过快，可出现头昏、嗜睡或激动不安、感觉异常等。剂量过大可引起心率减慢，房室传导阻滞和低血压。眼球震颤是利多卡因毒性反应的早期信号。普萘洛尔（C错）可致窦性心动过缓、房室传导阻滞，并可能诱发心力衰竭和哮喘。产生低血压、精神压抑、记忆力减退。本药长期应用对脂质代谢和糖代谢有不良影响。突然停药可产生反跳现象，使冠心病患者发生心绞痛加重或心肌梗死。苯巴比妥钠（E错）是长效巴比妥类的典型代表，为镇静、催眠、抗惊厥药。用药后可出现头昏、困倦等后遗反应，久用可产生耐受性及依赖性。多次连用应警惕蓄积中毒。少数患者可出现皮疹、剥脱性皮炎等过敏反应。长期用药，偶见叶酸缺乏和低钙血症。罕见巨幼红细胞性贫血和骨软化。大剂量时可产生眼球震颤、共济失调和严重的呼吸抑制。